与面神经有关的神经核
A. 动眼神经副核
B. 下泌涎核
C. 孤束核
D. 红核
E. 下橄榄核

正确答案：C。孤束核

解析：与面神经有关的神经核有面神经核、上泌涎核、孤束核（C对）。